B系急性淋巴细胞白血病（B-ALL）最常出现的免疫分子标志是
A. CD2
B. CD34
C. CD19
D. CD38
E. CD7

正确答案：C。CD19

解析：B系急性淋巴细胞白血病（B-ALL）最常出现的免疫分子标志是CD19（C对）。CD2（A错）、CD7（E错）为T系淋巴细胞最常出现的免疫分子标志（九版内科学P572），CD34（B错）、CD38（D错）为干细胞／祖细胞最常出现的免疫分子标志物（九版内科学P532）。